反复发作并形成两颊瘘的第三磨牙牙冠周炎，其根治方法为
A. 切除瘘管
B. 拔除病原牙，搔刮瘘管
C. 切除瘘管，应用抗生素
D. 切除瘘管，局部冲洗
E. 拔除病原牙，切除瘘管

正确答案：E。拔除病原牙，切除瘘管

解析：本题考查智齿冠周炎的治疗。反复发作并形成两颊瘘的第三磨牙牙冠周炎，其根治方法为拔除病原牙，切除瘘管（E对）。下颌智齿牙位不正；无足够萌出位置；相对的上颌第三磨牙位置不正或已拔除者，以及为避免冠周炎的复发，均应尽早予以拔除。伴有面颊瘘者，在拔牙的同时应切除瘘道，刮尽肉芽，缝合面部皮肤瘘口。